抗菌药物预防性应用包括
A. 上呼吸道感染
B. 结肠手术前准备
C. 大面积烧伤
D. 原因不明的发热
E. 人造物留置手术

正确答案：B、C、E。结肠手术前准备；大面积烧伤；人造物留置手术

解析：本题考查抗菌药物预防性应用。预防性应用抗菌药的主要适应证：①严重创伤、开放性骨折、火器伤、腹内空腔脏器破裂、有严重污染和软组织破坏的创伤等。②大面积烧伤（C对）。③结肠手术前肠道准备（B对）。④营养不良、全身情况差或接受激素、抗癌药物等的病人需做手术治疗时。⑤进行人造物留置手术（E对）。⑥有心脏瓣膜病或已植有人工心脏瓣膜者，因病需做手术时。